新生儿应接种的疫苗是
A. 卡介苗、麻疹疫苗
B. 乙肝疫苗、卡介苗
C. 百白破混合制剂、乙肝疫苗
D. 脊髓灰质炎疫苗、麻疹疫苗
E. 百白破混合制剂、脊髓灰质炎疫苗

正确答案：B。乙肝疫苗、卡介苗

解析：本题考查儿童接种的免疫程序。乙肝疫苗应在出生时接种第一针，此后1个月时和6个月时再次接种。卡介苗（B对ACDE错）接种为诱导机体T细胞免疫反应，新生儿细胞免疫发育成熟，接种卡介苗反应好麻疹疫苗应在8个月时初种，7岁时加强。脊髓灰质炎疫苗在小儿2个月初服，3个月、4个月各复服1次。百白破疫苗应于第3个月、第4个月和第5个月时各接种1次。